某女，46岁。因小便频数短赤、灼热疼痛就诊，中医诊断为淋证。可参考淋证辨治的西医疾病是
A. 泌尿系感染
B. 性功能障碍
C. 肾功能衰竭
D. 肾病综合征
E. 肾小球炎

正确答案：A。泌尿系感染

解析：本题考查的是淋证。小便频数短赤、灼热疼痛就诊，中医诊断为淋证。可参考淋证辨治的西医疾病是泌尿系感染（A对）。淋证是指以小便频数短涩，淋沥刺痛，小腹拘急引痛为主症的疾病。西医学的泌尿系感染、尿路结石、前列腺炎、尿道综合征等病，具有淋证表现特征者，可参考此内容辨证论治。性功能障碍（B错）可参考阳痿辨证论治。阳痿是指男性除未发育成熟或已到性欲衰退期外，性交时阴茎不能勃起，或虽勃起但勃起不坚，或勃起不能维持，以致不能进行或完成性交全过程的疾病。西医学中勃起功能障碍表现为上述症状者，可参考此内容辨证论治。肾病综合征（D错）与肾小球炎（E错）可参考水肿辨证论治。水肿是体内水液潴留，泛滥肌肤，表现以头面、眼睑、四肢、腹背，甚至全身浮肿为特征的疾病。西医学中各种原因引起的水肿，如急、慢性肾小球肾炎、肾病综合征、继发性肾小球疾病等，以及肝性水肿、心性水肿、营养不良性水肿、功能性水肿、内分泌失调引起的水肿等，可参考此内容辨证论治。治疗肾功能衰竭（C错）可参考的病证，2022年考试指南未明确说明。